与全口义齿后缘有关的解剖标志不包括
A. 腭小凹
B. 颤动线
C. 腭乳头
D. 磨牙后垫
E. 翼上颌切迹

正确答案：C。腭乳头

解析：全口义齿后缘解剖包括：腭小凹、颤动线、磨牙后垫、翼上颌切迹，腭乳头属于前缘有关的标志。掌握“无牙颌的解剖标志及功能分区”知识点。